女，45岁。左乳房包块5个月，乳房无不适症状，有时感左肩背部不适，隐痛。查体：一般情况好，左乳房外上象限可触及3cm×2cm包块，质硬。不光滑，活动，无压痛，左腋窝触及3枚肿大淋巴结。钼靶摄片：左乳房2cm×2cm高密度影，周边有毛刺，中央有细沙样钙化点。患者术后3年出腰背部疼痛，逐渐加重，为明确诊断首选的主要检查是
A. PET-CT
B. CEA
C. CA15-3
D. 同位素骨扫描
E. 免疫指标检测

正确答案：D。同位素骨扫描

解析：乳腺癌易经椎旁静脉系统转移至椎体，因此乳腺癌患者术后3年诉腰背部疼痛，考虑乳腺癌椎体转移。为明确诊断首选的主要检查是同位素骨扫描（D对），其敏感性较高，不仅可以早期发现骨转移病灶，还对恶性肿瘤患者的临床分期、选择合适的治疗计划、判定疗效等方面具有重要价值。PET-CT（A错），即正电子发射计算机断层-CT与同位素骨扫描相比，具有半衰期短、骨骼系统辐射剂量小、图像分辨率高、对肿瘤检测灵敏度和特异性高等优势，但价格过于昂贵，因此一般不作首选。CEA（B错）即癌胚抗原（P391），主要用于预测直肠癌的预后和监测复发。CA15-3（C错）即癌胚抗原153主要用于辅助诊断乳腺癌及预后监测。免疫指标检测（E错）主要用于诊断自身免疫性疾病。